男孩，2岁。1岁时患麻疹后食欲差，常有腹泻，身高83cm，体重7600g，面色苍白，皮肤干燥，腹部皮下脂肪0.3cm，心音低钝，脉搏缓慢。假设此患儿清晨突然面色苍白、体温不升、呼吸暂停、神志不清，最可能的原因是
A. 低钙血症引起的喉痉挛
B. 低钾血症引起的呼吸肌麻痹
C. 自发性低血糖
D. 急性心力衰竭
E. 脱水引起休克

正确答案：C。自发性低血糖

解析：该患儿清晨突然面色苍白、体温不升、呼吸暂停、神志不清，又有蛋白质-能量营养不良的症状面色苍白，皮肤干燥，腹部皮下脂肪薄，所以判定为并发了自发性低血糖（C对）。低钙血症引起的喉痉挛多发生于新生儿出生后5～10天，多表现为肌张力增高，腱反射增强，踝阵挛可呈阳性（A错）。低钾血症常引起肌无力，胃肠道麻痹，心脏传导和节律异常，不引起呼吸肌麻痹（B错）。